决定病证虚实变化的主要病机是
A. 阴精阳气的盛衰
B. 脏腑功能活动的盛衰
C. 气血的盛衰
D. 正邪的盛衰
E. 邪气的有无

正确答案：D。正邪的盛衰

解析：邪正盛衰，指在疾病的发生、发展过程中，机体正气的抗病能力与致病邪气之间相互斗争所发生的盛衰变化，其不仅关系着疾病的发生，而且直接影响着疾病的发展和转归，同时也决定着病证的虚实变化（D对ABCE错）。